自然铜除了散瘀止痛外，还可
A. 疏肝解郁
B. 破血行气
C. 解蛇虫毒
D. 消肿生肌
E. 接骨疗伤

正确答案：E。接骨疗伤

解析：本题考查的是自然铜的功效。自然铜除了散瘀止痛外，还可接骨疗伤（E对）。自然铜：【功效】散瘀止痛，接骨疗伤。月季花：【功效】活血调经，疏肝解郁（A错）。莪术：【功效】破血行气（B错），消积止痛。五灵脂：【功效】活血止痛，化瘀止血，解蛇虫毒（C错）。乳香：【功效】活血止痛，消肿生肌（D错）。